可用于静脉注射脂肪乳的乳化剂有
A. 豆磷脂
B. 阿拉伯胶
C. 卵磷脂
D. 普朗尼克F68
E. 明胶

正确答案：A、C、D。豆磷脂；卵磷脂；普朗尼克F68

解析：本题考查注射剂常用附加剂。静脉用脂肪乳常用的乳化剂有卵磷脂（C对）、豆磷脂（A对）、普郎尼克F68（D对）等数种。阿拉伯胶（B错）和明胶（E错）为天然高分子乳化剂。